引起呼吸性碱中毒的原因主要是
A. 呼吸功能减弱
B. 通气过度
C. 吸入外界气CO2过多
D. 输入大量的碳酸氢钠溶液
E. 严重呕吐

正确答案：B。通气过度

解析：引起呼吸性碱中毒的原因主要是通气过度（B对）引起CO2 排出过多，最终导致PaC02降低、pH升高。